麻疹恢复期皮肤可见
A. 无色素斑痕
B. 无色素斑痕，可见脱屑
C. 有色素斑痕，可见脱屑
D. 有色素斑痕，无脱屑
E. 有色素斑痕，并有糠麸状细微脱屑

正确答案：E。有色素斑痕，并有糠麸状细微脱屑

解析：麻疹恢复期，若无并发症发生，出疹3～4天后，皮疹按出疹的先后顺序消退，体温开始下降，全身情况也随之好转。皮疹消退后出疹部位可见糠麸样脱屑，并有棕褐色色素沉着（E对）。无色素斑痕（A错）可见于幼儿急疹、风疹及猩红热。无色素斑痕，可见脱屑（B错）可见于风疹。